为了减少α受体阻断剂的副作用，适宜的服药时间是
A. 早餐前
B. 早餐后
C. 晚餐前
D. 晚餐中
E. 晚餐后临睡前

正确答案：E。晚餐后临睡前

解析：本题考查α受体阻断剂的使用。为了减少α受体阻断剂的副作用，适宜的服药时间是晚餐后临睡前（E对）。α受体阻断剂不作为高血压治疗的首选药，适用于高血压伴前列腺增生症患者，也用于难治性高血压患者的治疗。初次给药应在睡前上床后服用，以预防体位性低血压发生。体位性低血压者禁用，心力衰竭者慎用。